生态系统健康是
A. 人和生态系统相互关系的综合特性
B. 生态系统对人健康影响的特性
C. 人对生态系统影响的综合特性
D. 生态系统的综合特性
E. 生态系统之间相互影响的综合特性

正确答案：D。生态系统的综合特性

解析：本题考查生态系统健康。生态系统健康是指具有活力和自调节能力、结构稳定的生态系统，是生态系统的综合特性（D对ABCE错）。